宫颈癌多发生在晚期的转移为
A. 直接蔓延
B. 医源转移
C. 血行转移
D. 腺行转移
E. 淋巴转移

正确答案：C。血行转移

解析：本题考查宫颈癌。血行转移（C对）多发生在晚期。